前庭功能失调（眩晕）
A. 米诺环素
B. 甲硝唑
C. 左氧氟沙星
D. 哌拉西林
E. 罗红霉素

正确答案：A。米诺环素

解析：本题考查药物的不良反应。米诺环素（A对）可以导致前庭功能失调（眩晕）。甲硝唑（B错）可引起双硫仑样反应。左氧氟沙星（C错）：重症肌无力、癫痫患者禁用。哌拉西林（D错）：有过敏史、出血史、溃疡性结肠炎、克隆病或抗生素相关肠炎者慎用。罗红霉素（E错）与红霉素存在交叉耐药性。